白血病的牙龈病损时出现组织坏死、溃疡、口臭原因是
A. 大量幼稚血细胞浸润积聚，末梢血管栓塞，局部组织对感染的抵抗力降低
B. 牙龈结缔组织本身的增生
C. 牙龈结缔组织部分的红细胞大量浸润积聚
D. 物理、化学刺激
E. 菌斑大量堆积

正确答案：A。大量幼稚血细胞浸润积聚，末梢血管栓塞，局部组织对感染的抵抗力降低

解析：白血病的牙龈病损时龈缘处组织坏死、溃疡和假膜形成，状如坏死性溃疡性龈炎，严重者坏死范围广泛，有口臭其主要是由于牙龈中大量幼稚血细胞浸润积聚，可造成末梢血管栓塞，局部组织对感染的抵抗力降低所致。掌握“白血病龈病损”知识点。